桩核冠桩至少离开根尖部的距离为
A. 1mm
B. 1.5mm
C. 2mm
D. 2.5mm
E. 5mm

正确答案：E。5mm

解析：桩的长度：为确保牙髓治疗效果和预防根折，一般要求根尖部至少保留5mm的充填材料，桩的长度为根长的2/3～3/4。掌握“桩核冠”知识点。